以下不属于发生口角炎常见病因的是
A. 维生素B₂缺乏
B. 白色念珠菌感染
C. 过度日光照射
D. 接触变应原
E. 口腔治疗时牵拉时间过长

正确答案：C。过度日光照射

解析：不属于发生口角炎常见病因的是过度日光照射（C错，为本题的正确答案）。过度日光照射可引起光化性唇炎，不能引起口角炎。口角炎是发生于上下唇两侧联合处口角区的炎症总称，以皲裂、口角糜烂和结痂为主要症状，根据发病原因可分为营养不良性、感染性、接触性和创伤性。营养不良性口角炎是由营养不良、维生素缺乏引起，或继发于糖尿病、贫血、免疫功能异常等全身疾病引起的营养不良，维生素B2缺乏（A对）达1年之久者，可因体内生物氧化过程长期不正常或脂肪代谢障碍发生口角炎。感染性口角炎是由真菌、细菌、病毒等病原微生物引起的，白色念珠菌感染（B对）是其常见原因。对于部分有过敏体质的患者，接触变应原（D对）或毒性物质可引起接触性口角炎，某些唇膏、脸霜等化妆品以及某些药物食品等也可能是接触性口角炎的直接病因。创伤性口角炎是由口角区医源性创伤、严重的物理刺激或某些不良习惯引起，例如：口腔治疗时牵拉时间过长（E对），使用粗糙的一次性口镜造成口角破损；用手机制备牙体时不慎碰伤口角等。